支饮的临床主症是
A. 其人素盛今瘦，水走肠间，沥沥有声
B. 心下痞坚，胸胁支满，目眩
C. 咳逆倚息，短气不得卧，其形如肿
D. 咳唾引痛，痛引缺盆，咳嗽则辄已
E. 身体疼重，四肢历节痛

正确答案：C。咳逆倚息，短气不得卧，其形如肿

解析：支饮是水饮停留于胸膈，影响心肺。饮聚胸膈，凌心射肺。肺失宣降，心阳被遏则咳嗽气逆，短气不能平卧，须倚床呼吸；肺合皮毛，水随气逆，故兼见外形如肿（C对）。